患者，男，23岁。有花粉过敏史，突然出现咳嗽，打喷嚏，呼吸困难，不能平卧，喉中痰鸣，发热，汗出，舌红苔黄，脉弦滑。对诊断最有意义的检查是
A. 肺功能
B. 心电图
C. 血气分析
D. 血常规
E. 痰涂片镜检、培养

正确答案：A。肺功能

解析：本例患者为青年男性，有花粉过敏史，此次突发咳嗽，打喷嚏，呼吸困难，不能平卧，喉中痰鸣，发热，汗出，舌红苔黄，脉弦滑，诊断首先考虑支气管哮喘。对诊断最有意义的检查是肺功能（A对）检查，支气管哮喘患者肺功能检查可表现为限制性通气功能障碍。心电图（B错）对支气管哮喘的诊断意义不大。血气分析（C错）、血常规（D错）、痰涂片镜检、培养（E错）对支气管哮喘的诊断有一定作用，但不是诊断支气管哮喘最有意义的检查。